女，30岁。4年前血小板减少，2年前间断面部红斑伴低热。实验室检查：抗核抗体（+），抗心磷脂抗体（+），诊断系统性红斑狼疮。此次妊娠6个月，胎死宫内，同时出现左下肢深静脉血栓。考虑合并的疾病是
A. 妊娠期高血压疾病
B. 干燥综合征
C. 弥散性血管内凝血
D. 抗磷脂综合征
E. 血管闭塞性脉管炎

正确答案：D。抗磷脂综合征

解析：青年女性SLE患者（患有自身免疫性疾病），妊娠6月发生流产，且发生左下肢深静脉血栓（抗磷脂综合征常见症状：习惯性流产、下肢深静脉血栓），实验室检查：抗核抗体（+），抗心磷脂抗体（+），结合上述病史和临床表现，患者患系统性红斑狼疮合并抗磷脂综合征（D对）可能性大。妊娠期高血压疾病（A错）主要表现为妊娠期血压增高，且既往无高血压病史。干燥综合征（B错）可见唾液腺和泪腺功能不全。弥散性血管内凝血（C错）主要表现为全身血管弥散性血管内凝血，不单局限于下肢。血管闭塞性脉管炎（E错）好发于男性青壮年，与吸烟相关，起病隐匿，进展缓慢。